女，25岁，3个月前因工作失误受到领导批评，觉得脸上无光，觉得同事看不起她，在背后议论她，不好意思出门，耳边常有命令性幻听，查体：躯体及神经系统无阳性体征。经药物治疗仍然极度兴奋则进一步选择治疗方案
A. 改良电抽搐治疗
B. 心理治疗
C. 针灸治疗
D. 中药治疗
E. 加大药物剂量

正确答案：A。改良电抽搐治疗

解析：该青年女性，3个月前觉得同事在背后议论她（关系妄想），耳边常有命令性幻听（听幻觉），不好意思出门（在妄想和幻觉的支配下表现的行为），查体：躯体及神经系统无阳性体征。故最可能诊断为精神分裂症。本例患者经药物治疗仍然极度兴奋应合用辅助药物（增效药物），或电抽搐（ECT）治疗（A对），或经颅磁刺激治疗，或联合使用不同种类的抗精神病药物，亦可单独应用ECT治疗。